女，20岁。夜间排尿后突然右下腹剧痛，随后恶心呕吐。平时月经规律，末次月经为10天前。妇科检查子宫右侧可触及手拳大小囊实性包块，触痛推移后疼痛加剧。首先考虑
A. 输卵管妊娠破裂
B. 急性阑尾炎
C. 急性附件炎
D. 卵巢囊肿蒂扭转
E. 卵巢黄体破裂

正确答案：D。卵巢囊肿蒂扭转

解析：患者为年轻女性，夜间排尿后突然右下腹剧痛，随后恶心呕吐（蒂扭转的典型症状是体位改变后突然发生一侧下腹剧痛，常伴恶心、呕吐甚至休克）。平时月经规律，末次月经为10天前（患者处于卵泡期，未排卵形成黄体，且无停经史）。妇检：子宫右侧可触及手拳大小囊实性包块，肿物推移后疼痛加剧（双合诊检查可扪及压痛的肿块，以蒂部最明显），首先考虑为卵巢囊肿蒂扭转（D对）。输卵管妊娠破裂（P53）（A错）有6～8周停经史，表现为突感一侧下腹部剧烈疼痛，并伴有恶心、呕吐，常有不规则少量阴道流血。急性阑尾炎（B错）常表现为转移性右下腹痛，右下腹的压痛和反跳痛。急性附件炎（C错）常见症状为下腹痛、阴道分泌物增多，严重时可出现高热、寒战、头痛等。卵巢黄体破裂（P55）（E错）常发生于月经中后期，表现为不规则少量阴道流血，妇检无肿块触及，有一侧附件压痛。